尿细菌培养为粪肠球菌，具有诊断意义的菌落计数至少大于
A. 10/ml
B. 100/ml
C. 1000/ml
D. 10000/ml
E. 100000/ml

正确答案：C。1000/ml

解析：尿路感染确诊的重要实验室依据为尿细菌培养。尿路细菌≥10⁵/ml为真性菌尿，此标准适用于革兰阴性杆菌。因球菌繁殖较杆菌缓慢，因此尿细菌培养在10³（C对）～10⁴/ml，可确诊尿路感染。